叶酸的良好食物来源是
A. 绿叶蔬菜
B. 粮谷类
C. 植物油
D. 水果
E. 鱼类

正确答案：A。绿叶蔬菜